男孩，1岁。发热3天，呕吐1次，抽搐1次，既往6个月曾热性惊厥1次。按时预防接种，出生史无特殊。查体：T38.2℃，R30次/分，BP90/55mmHg，颈抵抗（＋），双肺听诊未见异常。心率130次/分，律齐，腹软，肝脾肋下未触及，四肢暖，肌力、肌张力正常。Babinski征（+）。初步诊断首先考虑
A. 中毒型细菌性痢疾
B. 中枢神经系统感染
C. 脑发育不全
D. 热性惊厥
E. 手足搐搦症

正确答案：B。中枢神经系统感染

解析：男性幼儿患者，发热3天，呕吐1次，抽搐1次，既往6个月曾热性惊厥1次，颈抵抗（＋），Babinski征（+）。患者有惊厥、颅内压增高表现，综合患者的症状、体征和辅助检查，初步诊断首先考虑中枢神经系统感染（B对）。中毒型细菌性痢疾（A错）表现为急性高热、呼吸困难、烦躁不安，发绀进行性加重等，多无颅内压增高的表现。脑发育不全（C错）多无颅内压增高的表现。热性惊厥（D错）由颅外感染引起。手足搐搦症（E错）由血钙过低、血镁过低、血钠过高引起，多无颅内压增高的表现。